男，47岁。水肿6个月。查体：BP120/70mmHg。尿蛋白定量2.5g/d，尿红细胞20～30/HP，血白蛋白32g/L，血肌酐141umol/L。临床诊断为
A. 急性肾小球肾炎
B. 慢性肾小球肾炎
C. 急进性肾小球肾炎
D. 无症状性蛋白尿和（或）血尿
E. 肾病综合征

正确答案：B。慢性肾小球肾炎

解析：患者病程6月，临床表现为水肿，实验室检查提示蛋白尿、血尿及肾功能受损，应考虑慢性肾小球肾炎（B对）。无症状性蛋白尿和（或） 血尿（D错）无水肿等临床症状（P477）。急性肾小球肾炎（A错）、急进性肾小球肾炎（C错）起病均较急，病程短，该患者病程6个月，不符合此诊断。肾病综合征（E错）诊断标准是：①尿蛋白大于3.5g/d；②血浆白蛋白低于30g/L；③水肿；④血脂升高（P470），与该患者病情不符合。